分子中含有酯基，在体内易代谢的超短效β₁-受体拮抗剂是
A. 盐酸普萘洛尔
B. 盐酸索他洛尔
C. 酒石酸美托洛尔
D. 艾司洛尔
E. 马来酸噻吗洛尔

正确答案：D。艾司洛尔

解析：本题考查β-受体拮抗剂的作用特点。艾司洛尔（D对）是根据软药原理得到的超短效的β₁受体拮抗剂。